患者，男，60岁。反复咳嗽、咯痰10年。近3年每于秋冬发病，天气变暖后逐渐减轻。检查：两肺闻及散在干啰音，X线显示肺纹理增多。其诊断是
A. 肺结核
B. 肺癌
C. 支气管扩张
D. 支气管哮喘
E. 慢性支气管炎

正确答案：E。慢性支气管炎

解析：本例患者为老年男性，有反复咳嗽、咯痰病史，常于秋冬季节发病，此次检查发现两肺有散在干啰音，X线检查显示肺纹理增多，故诊断首先考虑的是慢性支气管炎（E对）。肺结核（A错）主要表现为咳嗽、咳痰、午后潮热和盗汗，发病与季节关系不大，部分患者检查时可发现异常体征如支气管呼吸音，X线检查与肺结核类型有关。肺癌（B错）主要表现为刺激性干咳和持续性痰中带血，部分患者查体可见局限性或单侧哮鸣音，中央型肺癌X线检查可有"倒S征"，周围型肺癌X线检查可有分叶征或毛刺征。支气管扩张（C错）主要表现为慢性咳嗽、咯大量脓痰和反复咯血，查体可闻及湿啰音与干啰音，部分患者X线检查可发现囊腔。支气管哮喘（D错）主要表现为发作性伴有哮鸣音的呼气性呼吸困难，查体可见双侧呼吸动度减弱、语颤减弱，叩诊呈过清音，呼吸音常减弱，哮喘发作时X线检查可见两肺透亮度增加，呈过度通气状态，缓解期多无明显异常。